通过亲性腺作用损害生殖与发育过程的化学物是
A. 反应停
B. 维生素A
C. 5-羟色胺
D. 甲基汞
E. 氯化镉

正确答案：E。氯化镉